人工授精和体外受精技术在临床上的运用，出现了
A. 体外受精
B. 克隆技术
C. 人工授精
D. 异体受孕
E. 代孕母亲

正确答案：E。代孕母亲

解析：代孕母亲：人工授精和体外受精技术在临床上的运用，出现了代孕母亲。掌握“人类生殖技术伦理”知识点。